贫血患者常出现
A. 血红蛋白减少
B. 中性粒细胞增多
C. 嗜酸性粒细胞增多
D. 血小板计数增多
E. 淋巴细胞增多

正确答案：A。血红蛋白减少

解析：本题考查血常规检查。贫血患者常出现血红蛋白减少（A对）。血红蛋白能更好地反映贫血的程度。贫血按严重程度可分为：极重度贫血，Hb量＜30g/L；重度贫血， 30g/L≤Hb量＜60g/L；中度贫血，60g/L≤Hb量＜90g/L；轻度贫血，90g/L≤Hb量＜正常参考范围下限。中性粒细胞增多（B错）最常见的原因是急性感染和化脓性炎症。嗜酸性粒细胞增多（C错）常见于过敏性疾病，如支气管哮喘、荨麻疹、食物过敏、血清病等。血小板计数增多（D错）常见于慢性粒细胞性白血病、真性红细胞增多症、急性出血等。淋巴细胞增多（E错）常见于传染病，如百日咳、水痘、麻疹、流行性腮腺炎、传染性肝炎等。